对临床诊疗道德中最优化原则理解全面的是
A. 采取没有风险的治疗手段
B. 选择以最小代价获得最大效果的治疗方案
C. 选择让患者花费最少的治疗方案
D. 尽可能使用保守治疗方案
E. 采取使患者没有痛苦的治疗手段

正确答案：B。选择以最小代价获得最大效果的治疗方案

解析：临床诊疗的医学道德原则中的择优准则即最优化原则是指认真、仔细地选择使病人受益与代价比例适当的优化治疗措施的临床伦理准则，即选择以最小代价获得最大效果的治疗方案（B对）的临床伦理准则。采取没有风险的治疗手段（A错）、选择让患者花费最少的治疗方案（C错）、尽可能使用疗效最好（而不是保守）的治疗方案（D错）、采取使患者没有痛苦的治疗手段（E错）只是最优化原则内容的一部分。